女，36岁。呼吸困难伴声嘶2个月，活动后明显，无慢性咳嗽咳痰和关节疼痛病史。查体：口唇发绀，颈静脉充盈，肝颈回流征阳性，P₂亢进，三尖瓣可闻及3/6级收缩期杂音，双下肢水肿，其最可能的诊断是
A. 特发性肺动脉高压
B. 风湿性心脏瓣膜病
C. 房间隔缺损
D. 室间隔缺损
E. 扩张型心肌病

正确答案：A。特发性肺动脉高压

解析：该患者为中年女性，呼吸困难伴声嘶2个月，活动后明显，口唇发绀合并颈静脉充盈及肝静脉反流征阳性（提示右心衰竭），P₂亢进并有三尖瓣收缩期杂音（提示肺动脉高压），因此最可能的诊断为特发性肺动脉高压（A对）（该患者符合特发性肺动脉高压的临床表现及体征）。患者无慢性咳嗽、咳痰和关节痛病史，故暂不首先考虑慢性呼吸系统疾病和风湿性心脏瓣膜病（B错）（P285）。房间隔缺损（C错）（P272）一般为先天性疾病，体检最典型体征为肺动脉区第二心音亢进呈固定分裂，并可闻及2～3级收缩期喷射性杂音，本患者未出现房间隔缺损的典型症状。室间隔缺损（D错）（P273）一般为先天性疾病，患者一般在幼年时就有明显症状，不符合本病患者成年时突然起病的特点。扩张型心肌病（E错）（P261）主要表现为活动时呼吸困难和活动耐量下降，随病情进展可出现有心功能不全表现，但其典型体征为心界扩大以及听诊心音减弱，常可闻及第三或第四心音，本患者未出现这些典型体征。